某男，57岁。小便不通或点滴不爽，排出无力，腰膝酸软，畏寒肢冷；舌淡胖苔薄白，脉沉细。诊断为癃闭，证属肾阳衰惫。宜选用的中成药是
A. 癃清片
B. 济生肾气丸
C. 前列通片
D. 癃闭舒胶囊
E. 前列通瘀胶囊

正确答案：B。济生肾气丸

解析：本题考查的是癃闭的辨证论治。某男，57岁。小便不通或点滴不爽，排出无力，腰膝酸软，畏寒肢冷；舌淡胖苔薄白，脉沉细。诊断为癃闭，证属肾阳衰惫。宜选用的中成药是济生肾气丸（B对）。癃闭是以小便量少，排尿困难，甚则小便闭塞不通为主症的疾病。（一）膀胱湿热证：【中成药应用】常用中成药有八正合剂、清淋颗粒。（二）湿热瘀阻证：【中成药应用】常用中成药有癃清片（A错）、前列通瘀胶囊（E错）、前列通片（C错）、癃闭舒胶囊（D错）。（三）肾阳衰惫证：【中成药应用】常用中成药有济生肾气丸、金匮肾气丸。